患者心烦不寐，心悸不安，头晕，耳鸣，健忘，腰酸梦遗，五心烦热，口干津少，舌红，脉细数。治法为
A. 清心宁神，养阴除烦
B. 养阴生津，除烦宁神
C. 清火除烦，宁心安神
D. 滋阴降火，交通心肾
E. 滋阴宁心，镇惊安神

正确答案：D。滋阴降火，交通心肾

解析：根据“心烦不寐”可知病为“不寐”；根据“心悸不安，头晕，耳鸣，健忘，腰酸梦遗，五心烦热，口干津少，舌红，脉细数”可辨为“心肾不交证”，其机理为肾阴耗伤，阴衰于下，不能上奉于心，水火不济，心火独亢，火盛神动，心肾失交而神志不宁；治疗应滋阴降火，交通心肾，养心安神（D对）。而不可单纯养阴或清火（ABCE错）。